天麻头痛片既能养血祛风，又能
A. 散寒止痛
B. 泻火止痛
C. 活血止痛
D. 行气止痛
E. 缓急止痛

正确答案：A。散寒止痛

解析：本题考查的是天麻头痛片的功能。天麻头痛片既能养血祛风，又能散寒止痛（A对）。天麻头痛片【功能】养血祛风，散寒止痛。黄连上清丸【功能】散风清热，泻火止痛（B错）。小活络丸【功能】祛风散寒，化痰除湿，活血止痛（C错）。复方黄连素片【功能】清热燥湿，止痢止泻，行气止痛（D错）。小建中合剂【功能】温中补虚，缓急止痛（E错）。